肝细胞水肿的病变是
A. 肝细胞轮廓可见，胞核浓缩，核膜消失
B. 肝细胞体积增大，双核，核仁明显
C. 肝细胞体积增大，胞质内大小不等的空泡，苏丹（﹢）
D. 肝细胞体积增大，胞质疏松，淡染，透明度增加
E. 肝细胞体积缩小，胞质疏松，透明度增加

正确答案：D。肝细胞体积增大，胞质疏松，淡染，透明度增加

解析：肝细胞水肿是病毒性肝炎最常见的病变，光镜下可见肝细胞体积明显增大，胞质疏松，淡染，透明度增加（D对）。肝细胞轮廓可见，胞核浓缩（A错）是肝细胞凋亡的病变特点。肝细胞体积增大，双核，核仁明显（B错）是肝硬化（P201）时假小叶内肝细胞的病变特点。肝细胞体积增大，胞质内大小不等的空泡，苏丹（+）（C错）是肝细胞脂肪变（P15）的病变特点。